以下可摘局部义齿禁忌证，除外的是
A. 对义齿的异物感无法克服的患者
B. 严重的牙体疾病而未得到完善治疗的患者
C. 咬合垂直距离过低的患者
D. 生活不能自理的患者
E. 对义齿材料过敏的患者

正确答案：C。咬合垂直距离过低的患者

解析：余留牙重度磨耗等原因导致的咬合垂直距离过低，需恢复面部垂直距离者，属于可摘局部义齿的适应症。答案为C。掌握“局部义齿的适应证与禁忌证”知识点。